女童，5岁，来院进行口腔健康检查并咨询有关口腔保健知识，家长向医生了解幼儿刷牙能否用含氟牙膏时，医生的回答是
A. 最好不用
B. 应该不用
C. 监督使用
D. 间断使用
E. 长期使用

正确答案：C。监督使用

解析：含氟牙膏的使用和防龋效果：对于6岁以上的儿童和成人，每天用含氟浓度高于1000mg/kg的牙膏刷牙2次，每次用量约1g，可达到有效的预防效果。3～6岁的儿童，每次牙膏用量约为“豌豆”大小，同时，应在家长监督与指导下使用，以免儿童过多的吞咽牙膏，导致产生氟牙症的危险。在饮水氟含量过高，有地氟病流行的地区，6岁以下的儿童不推荐使用含氟牙膏。掌握“氟的全身及局部应用”知识点。